下列不属于咀嚼肌的是
A. 翼内肌
B. 翼外肌
C. 颊肌
D. 咬肌
E. 颞肌

正确答案：C。颊肌

解析：翼内肌（A对）、翼外肌（B对）、咬肌（D对）、颞肌（E对）均属于咀嚼肌，而颊肌（C错，为本题正确答案）属于面肌，而非咀嚼肌。